硫酸阿托品特征鉴别反应所采用的试剂是
A. 硫酸铜
B. 溴水和氨试液
C. 发烟硝酸和醇制氢氧化钾
D. 甲醛硫酸试液
E. 重铬酸钾

正确答案：C。发烟硝酸和醇制氢氧化钾

解析：本题考查常用的药品鉴别方法。硫酸阿托品特征鉴别反应所采用的试剂是发烟硝酸和醇制氢氧化钾（C对）。托烷生物碱如硫酸阿托品、氢溴酸东莨菪碱为酯类生物碱，水解后生成莨菪酸，经发烟硝酸加热处理，转变为三硝基衍生物，再与氢氧化钾溶液和固体氢氧化钾作用，转成有色的醌型产物，呈深紫色。盐酸麻黄碱、盐酸伪麻黄碱和盐酸去氧肾上腺素等药物分子结构中，芳环侧链具有氨基醇结构，可显双缩脲特征反应，即在碱性条件下与硫酸铜（A错）形成蓝色配位化合物，水层显蓝色。氨气通入溴水（B错）中，可使其褪色。甲醛-硫酸试液（D错）的反应（Marquis反应）系含酚羟基的异喹啉类生物碱的专属鉴别反应。该类药物遇甲醛-硫酸试液可形成具有醌式结构的有色化合物。重铬酸钾（E错）酸性水溶液遇到乙醇会迅速生成蓝绿色三价离子，溶液变成灰绿色。用于检测乙醇。